巨噬细胞对外源性抗原加工处理和提呈过程不包括
A. 吞噬体形成
B. 吞噬溶酶体形成
C. 抗原降解成抗原肽
D. 抗原在内质网中加工修饰
E. 抗原肽与MHCⅡ类分子结合形成复合物

正确答案：D。抗原在内质网中加工修饰